下列物质中参加胆固醇酯化成胆固醇酯过程的是
A. LCAT
B. LDL
C. LPL
D. LDH
E. HMG-CoA还原酶

正确答案：A。LCAT